功能疏风清热、宣肺止咳的成药是
A. 参苏胶囊
B. 羚羊感冒胶囊
C. 桑菊感冒片
D. 午时茶颗粒
E. 正柴胡饮颗粒

正确答案：C。桑菊感冒片

解析：本题考查桑菊感冒片的功能。功能疏风清热、宣肺止咳的成药是桑菊感冒片（C对）。参苏胶囊桑菊感冒片（颗粒、丸、合剂）【功能】疏风清热，宣肺止咳。参苏胶囊（A错）【功能】益气解表，疏风散寒，祛痰止咳。羚羊感冒胶囊（B错）【功能】清热解表。午时茶颗粒（D错）【功能】祛风解表，化湿和中。正柴胡饮颗粒（E错）【功能】发散风寒，解热止痛。